男性尿道可分为
A. 前列腺部、膜部、阴茎部
B. 前尿道、中尿道、后尿道
C. 前列腺部、膜部、后尿道
D. 前列腺部、膜部、海绵体部
E. 前尿道、膜部、海绵体部

正确答案：D。前列腺部、膜部、海绵体部

解析：男性尿道分前列腺部、膜部和海绵体部三部分（D对）。